伤寒确诊依赖于
A. 临床五大特点
B. 阳性流行病学资料
C. 肥达反应阳性
D. 血培养伤寒杆菌阳性
E. 用氯霉素治疗效果良好

正确答案：D。血培养伤寒杆菌阳性